儿童生长监测图中5条参考曲线是
A. 从上到下依次为P₁₀₀、P₈₅、P₅₀、P₁₅、P₅
B. 从上到下依次为P₉₈、P₈₀、P₅₀、P₂₀、P₅
C. 从上到下依次为P₉₇、P₈₅、P₅₀、P₁₅、P₃
D. 从上到下依次为P₉₅、P₈₅、P₅₀、P₁₅、P₃
E. 从上到下依次为P₉₅、P₇₅、P₅₀、P₁	₀、P₃

正确答案：C。从上到下依次为P₉₇、P₈₅、P₅₀、P₁₅、P₃

解析：本题考查儿童生长监测图中5条参考曲线。儿童生长监测图是将同性别、各个年龄组儿童体重或其他指标的数值标在坐标纸上，连成参考曲线而绘制的图。儿童生长监测图的底端是年龄刻度，每月一格。左侧是体重的公斤数值。图中通常有5条参考曲线，最上端一条为 P₉₇，下面的曲线依次为P₈₅、P₅₀、P₁₅，最下端的1条是P₃（C对ABDE错）。中间的一条曲线代表第50百分位数值（P₅₀），相当于平均值，即平均身长（身高）、平均体重等。最下面一条曲线代表第3百分位数值（P₃），低于这一水平可能存在生长迟缓最上面一条曲线代表第97百分位数值（P₉₇），高于这一水平可能存在生长过速。